大孔吸附树脂分离黄酮混合物，常用的洗脱剂是
A. n-BuOH-HOAc-H₂O（4:1:5 上层，BAW）
B. 石油醚
C. 2%三氯化铝甲醇溶液
D. 不同浓度的乙醇-水混合溶液
E. 四氢硼钠

正确答案：D。不同浓度的乙醇-水混合溶液

解析：本题考查的是大孔吸附树脂的常用洗脱剂。大孔吸附树脂分离黄酮混合物，常用的洗脱剂是不同浓度的乙醇-水混合溶液（D对）。大孔吸附树脂适用于从水溶液中分离低极性或非极性化合物，组分间极性差别越大，分离效果越好。大孔树脂用于中药化学成分的分离时，通常将中药提取物的水溶液吸附于大孔树脂后，一般依次用水、含水甲醇、乙醇或丙酮10%、20%、30%（体积分数）洗脱，最后用浓醇或丙酮洗脱，获得若干组分。苷类化合物多属极性较大的物质，其纸色谱一般用水饱和的有机溶剂为展开剂，如正丁醇-冰乙酸-水（4：1：5，上层）（A错）、正丁醇-乙醇-水（4：2：1）和水饱和的苯酚等。硅胶薄层为常用方法，依据检识成分的极性确定展开剂，展开剂多为石油醚（B错）、环己烷，分别加入不同比例的乙酸乙酯或乙醚，极性大的萜醇或萜酸类可加入三氯甲烷或甲酸、乙酸展开分离。黄酮类化合物大多具有颜色，且在紫外光下显示不同颜色的荧光，可直接用于斑点定位，也可以色谱展开后喷2%三氯化铝甲醇液试（C错）剂后，置于紫外灯下观察荧光斑点。大孔吸附树脂适用于从水溶液中分离低极性或非极性化合物，组分间极性差别越大，分离效果越好。四氢硼钠（E错）是对二氢黄酮类化合物专属性较高的一种还原剂，二氢黄酮类化合物可被四氢硼钠还原产生红～紫红色。其他黄酮类化合物均不显色，可与之区别。